在《中国药典》中，收载“制剂通则”的部分是
A. 目录
B. 凡例
C. 正文
D. 附录
E. 索引

正确答案：D。附录